既祛风通络，又凉血消肿的药是
A. 秦艽
B. 蕲蛇
C. 桑枝
D. 海风藤
E. 络石藤

正确答案：E。络石藤

解析：本题考查络石藤的功效。既祛风通络，又凉血消肿的药是络石藤（E对）。络石藤【功效】祛风通络，凉血消肿。秦艽（A错）【功效】祛风湿，舒筋络，清虚热，利湿退黄。蕲蛇（B错）【功效】祛风通络，定惊止痉。桑枝（C错）【功效】祛风通络，利水。海风藤（D错）【功效】祛风湿，通经络。